是牙齿发育的组织中心，调控牙尖的形态发生的是
A. 釉结
B. 釉索
C. 釉龛
D. 成釉器
E. 牙乳头

正确答案：A。釉结

解析：釉结中信号分子基因表达在牙胚发育过程中随时间和空间变化而发生动态改变。釉结是牙发育的组织中心，调控牙尖的形态发生。掌握“牙胚的发生及分化”知识点。